频数表通常不用于
A. 描述资料的分布类型
B. 反映资料的集中趋势
C. 反映资料的离散趋势
D. 便于发现异常值
E. 总体均数的假设检验

正确答案：E。总体均数的假设检验

解析：本题考查频数分布表的相关内容。我们可从频数分布表得出数据的分布类型（A对）、集中位置（B对）、变异程度（C对）等整体概貌特征，如果从频数分布表看出数据不对称，则可进一步判断数据偏离的方向（D对）（E错，为本题的正确答案）。